上述各项，痰饮或疼痛者多见的脉象是
A. 涩脉
B. 弱脉
C. 细脉
D. 濡脉
E. 弦脉

正确答案：E。弦脉

解析：“弦脉，脉象特征为端直以长，如按琴弦，临床意义为多见于肝胆病、疼痛、痰饮等，或为胃气衰败者；亦可见于老年健康者”，故痰饮或疼痛者多见的脉象是弦脉（E对）。“涩脉，脉象特征为形细而行迟，往来艰涩不畅，脉势不匀，临床意义为多见于气滞、血瘀和精伤、血少”（A错）。“弱脉，脉象特征为沉细无力而软，临床意义为多见于阳气虚衰、气血俱虚”(B错)。“细脉，脉象特征为脉细如线，但应指明显，临床意义为多见于气血两虚、湿邪为病”（C错）。“濡脉，脉象特征为浮细无力而软，临床意义为多见于虚证或湿困”（D错）。